患者，男，60岁。主诉心胸憋闷疼痛，并放射至肩背，心悸怔忡，有恐惧感，舌稍紫有瘀点，舌苔白，脉沉细涩。其病机是
A. 心血亏虚
B. 肝血不足
C. 心阳偏衰
D. 心阴虚亏
E. 心血瘀阻

正确答案：E。心血瘀阻

解析：气郁日久，瘀血内停，脉络瘀阻则心胸憋闷疼痛，并放射至肩背；瘀血阻塞，心失所养，故心悸怔忡，有恐惧感；舌稍紫有瘀点，脉沉细涩，均符合心血瘀阻的病理表现（E对）。心血亏虚（A错）则可见心悸，失眠，多梦，健忘，头晕眼花，面色白或萎黄，唇舌色淡，脉细无力。肝血不足（B错）则容易出现头晕目眩，失眠多梦，面白无华，两目干涩，视物模糊，爪甲不荣，肢麻震颤，拘挛等临床表现。心阳偏衰（C错）主要表现为心气虚或心阳虚，以心悸气短，动辄益渗，神疲乏力等为主要临床特征。